食管癌的X线钡餐造影表现是
A. 黏膜皱襞呈蚯蚓状或串珠状充盈缺损
B. 食管下段鸟嘴样、漏斗状狭窄，狭窄边缘光滑
C. 黏膜皱襞消失、中断，管壁僵硬
D. 食管内高密度影
E. 食管贲门口上移，在膈上

正确答案：C。黏膜皱襞消失、中断，管壁僵硬

解析：食管癌的X线钡餐造影表现早期征象有：①黏膜皱襞增粗，迂曲及紊乱；②食管边缘毛刺状；③小充盈缺损及小龛影；④局限性管壁僵硬或有钡剂滞留。中晚期病例可见病变处管腔不规则狭窄、充盈缺损、管壁蠕动消失、黏膜紊乱、软组织影以及腔内型巨大充盈缺损（C对）。黏膜皱襞呈蚯蚓状或串珠状充盈缺损（A错）是食管静脉曲张的X线钡餐造影表现。食管下段鸟嘴样、漏斗状狭窄，狭窄边缘光滑（B错）是贲门失迟缓症的X线钡餐造影表现。食管癌X线钡餐造影是病变部位是低密度充盈缺损，钡剂是高密度，若病灶在造影时是高密度会被钡剂掩盖而不能显示病灶，因此食管内高密度影（D错）并非食管癌X线钡餐造影表现。食管贲门口上移，在膈上（E错）是滑动疝的X线钡餐造影表现。